整合于宿主菌染色体上，称为
A. 染色体
B. 质粒
C. 毒力岛
D. 转座因子
E. 前噬菌体

正确答案：E。前噬菌体

解析：带有温合噬菌体（如Mu噬菌体）的荣圆形细菌，其噬菌体基因组片段可整合到细菌染色体中，（称为前噬菌体），可使其细菌形状发生改变（称为溶原性转换）。掌握“细菌遗传变异的物质基础及机制”知识点。